镜下可见典型印戒细胞的卵巢肿瘤是
A. 库肯勃瘤
B. 纤维瘤
C. 无性细胞瘤
D. 畸胎瘤
E. 浆液性癌

正确答案：A。库肯勃瘤

解析：镜下可见典型印戒细胞的卵巢肿瘤是库肯勃瘤（A对），又称印戒细胞癌，是一种特殊的卵巢转移性腺癌，镜下见典型印戒细胞。纤维瘤（P330）（B错）属于卵巢性索间质肿瘤，镜下见梭形瘤细胞组成，排列呈编织状。无性细胞瘤（P329）（C错）和畸胎瘤（P329）（D错）同属于卵巢生殖细胞肿瘤，前者镜下见圆形或多角形大细胞，细胞核大，胞质丰富，瘤细胞呈片状或条索状排列，有少量纤维组织相隔，间质中常有淋巴细胞浸润；后者可见肿瘤组织多数成熟，少数未成熟；多数为囊性，少数为实性。浆液性癌（P326）（E错）属于卵巢上皮性肿瘤，镜下见囊壁上皮明显增生，复层排列，一般在4～5层以上。